某男，45岁。双眼睑下垂6～7天，渐加重，近一两天四肢或活动无力，晨起轻，下午重，休息后减轻，活动后加重。诊断：重症肌无力。对该病人最好用哪种药物治疗
A. 毛果芸香喊
B. 毒扁豆碱
C. 新斯的明
D. 阿托品
E. 加兰他敏

正确答案：C。新斯的明

解析：重症肌无力是一种自身免疫性疾病，骨骼肌呈进行性收缩无力，变现为眼睑下垂、肢体无力、咀嚼和吞咽困难，严重者可出现呼吸困难，新斯的明（C对）兴奋骨骼肌作用很强，皮下或肌肉注射新斯的明后，15分钟即可使肌无力症状减轻，维持2-4小时，除紧急情况需注射外，一般口服给药。毛果芸香碱（A错）可用于闭角型青光眼，用于开角型青光眼，常与扩瞳药交替使用，使瞳孔时扩时缩，可防止虹膜与晶状体粘连；口服可用于缓解放疗后的口腔干燥，全身用药用于阿托品中毒的抢救。毒扁豆碱（B错）副作用多，临床用于催醒和青光眼的治疗。阿托品（D错）临床主要用于解除平滑肌痉挛，抑制腺体分泌，虹膜睫状肌炎，检查眼底，验光配镜等，迷走神经过度兴奋引起的窦房阻滞、房室阻滞等缓慢型心律失常，还用于中毒性痢疾、中毒性肺炎等引起的感染中毒性休克，有机磷酸酯中毒等。加兰他敏（E错）可改善神经肌肉间的传导，国外作为第二代胆碱酯酶抑制剂用于治疗轻、中度阿尔兹海默症。